慢性支气管炎相关描述错误的是
A. 每年发病3个月，连续2年或2年以上
B. 咳嗽以夜间为主
C. 喘息
D. 反复咳嗽、咳痰
E. 咳白色泡沫样或黏稠痰

正确答案：B。咳嗽以夜间为主

解析：慢性支气管炎是气管、支气管黏膜及其周围组织的慢性非特异性炎症。依据咳嗽、咳痰或伴喘息，每年发病3个月，连续2年或2年以上，排除其他慢性气道疾病即可诊断。咳嗽以晨间为主，咳白色泡沫样或黏稠痰，偶有咯血，多为痰中带血。掌握“慢性支气管炎”知识点。